不起于肱骨内上髁的前臂前群肌是
A. 肱桡肌
B. 旋前圆肌
C. 桡侧腕屈肌
D. 掌长肌
E. 尺侧腕屈肌

正确答案：A。肱桡肌

解析：肱桡肌（A错，为本题正确答案）起于肱骨外上髁上方，而非肱骨内上髁。旋前圆肌（B对）、桡侧腕屈肌（C对）、掌长肌（D对）、尺侧腕屈肌（E对）均起于肱骨内上髁。